牙的最高部位低于第二磨牙的牙颈部属于
A. 正中位
B. 第Ⅱ类阻生
C. 垂直阻生
D. 低位阻生
E. 高位阻生

正确答案：D。低位阻生

解析：本题考查阻生牙的分类。牙的最高部位低于第二磨牙的牙颈部属于低位阻生（D对）。根据阻生牙相对于第二磨牙（牙合）平面的位置关系分为以下三种：1.高位阻生（E错）：牙的（牙合）平面到达或高于第二磨牙的（牙合）平面。2.中位阻生：牙的（牙合）平面位于第二磨牙的（牙合）平面和牙颈线之间。3.低位阻生：牙的（牙合）平面低于第二磨牙的牙颈线。牙拔除的难度随阻生牙埋伏的深度增加而增大。正中位（A错）是根据牙在正常牙列中线的位置进行分类的。第Ⅱ类阻生（B错）是根据阻生牙和下颌支前缘的关系分类的。垂直阻生（C错）是根据阻生第三磨牙的长轴与第二磨牙的长轴关系分类的。